下述哪项不是在妊娠期常见的心脏病
A. 围生期心肌病
B. 先天性心脏病
C. 心肌炎
D. 风湿性心脏病
E. 慢性高血压心脏病

正确答案：E。慢性高血压心脏病